IgC的论述不正确的是
A. 可作为早期诊断的标志
B. 是中和抗体
C. 有免疫力的标志
D. 感染后3~11个月达高峰
E. 可持续很长时间

正确答案：A。可作为早期诊断的标志